阴胜则阳病的病理表现是
A. 实寒
B. 虚寒
C. 实热
D. 虚热
E. 寒热错杂

正确答案：A。实寒